下列关于癌基因的叙述错误的是
A. 在体外引起细胞转化，在体内诱发肿瘤的基因
B. 在生物正常细胞基因组中的癌基因称为原癌基因
C. 在正常情况下癌基因处于高度活跃的状态
D. 当受到体内外致癌因素作用，发生突变，可导致细胞癌变
E. 癌基因可有病毒癌基因和细胞癌基因

正确答案：C。在正常情况下癌基因处于高度活跃的状态

解析：癌基因是指在体外引起细胞转化，在体内诱发肿瘤的基因。存在于生物正常细胞基因组中的癌基因又称为原癌基因或细胞癌基因。在正常情况下，这些基因处于静止或低表达的状态，对维持细胞正常功能具有重要作用。当其受到体内外致癌因素作用，发生过度表达或突变导致激活时，则可导致细胞癌变。癌基因可有病毒癌基因和细胞癌基因。掌握“癌基因与抑癌基因以及生长因子”知识点。